下列有关片剂制备的叙述中，错误的是
A. 颗粒中细粉太多能形成黏冲
B. 颗粒硬度小，压片后崩解快
C. 颗粒过干会造成裂片
D. 可压性强的原辅料，压成的片剂崩解慢
E. 随压力增大，片剂的崩解时间都会延长

正确答案：A、B、E。颗粒中细粉太多能形成黏冲；颗粒硬度小，压片后崩解快；随压力增大，片剂的崩解时间都会延长

解析：本题考查片剂制备中的常见问题及原因。片剂制备中可能产生的问题包括裂片、松片及崩解迟缓。裂片原因为物料颗粒过干（C对），细粉太多（A错，为本题正确答案），压缩时空气不能及时排出，导致压片后气体膨胀而裂片；松片原因为片剂硬度不够，稍加触动即散碎（B错，为本题正确答案）；影响崩解的主要原因是：①片剂的压力过大，导致内部空隙小，影响水分渗入（E错，为本题正确答案）；②增塑剂物料或黏合剂使片剂的结合力过强，可压性强的原辅料，压成的片剂崩解慢（D对）；③崩解剂性能较差。